依据内经所述，具有主蛰守位生理特性的脏是
A. 心
B. 肝
C. 脾
D. 肺
E. 肾

正确答案：E。肾

解析：本题考查肾的生理特性。肾的生理特性主蛰守位。主蛰，喻指肾有潜藏、封藏、闭藏之生理特性，是对其藏 精机能的高度概括。守位，是指肾中相火.（肾阳）涵于肾中，潜藏不露，以发挥其温煦、推动等作用（E对）。心的生理特性是为阳脏而主通明（A错）。肝的生理特性是主升主动，喜条达而恶抑郁，即肝为刚脏和肝气升发（B错）。脾的生理特性为脾气主升、喜燥恶湿（C错）。肺的生理特性为肺为华盖、肺为娇脏和肺气宣降（D错）。